牛乳喂养儿，其大便的特点是
A. 色暗褐，味腐臭
B. 色淡黄，质较硬
C. 色金黄，稍酸臭
D. 色橘黄，味臭秽
E. 色黄绿，无臭味

正确答案：B。色淡黄，质较硬

解析：牛乳的成分中含蛋白质较高，经肠道细菌水解后可见色淡黄，质较硬的粪便（B对）。大便色暗褐，味腐臭可见于急性坏死性肠炎（A错）。单纯母乳喂养的婴儿大便呈金黄色，稍酸臭（C错）。大便色橘黄，味臭秽，为肠腑湿热（D错）。大便色黄绿，无臭味，可见于消化不良或母乳喂养不足（E错）。